关于分根术的手术方法说法错误的是
A. 从正对根分叉部位沿患牙颊舌向发育沟切开，形成两个独立的单根牙
B. 伤口愈合期间最好不要制作暂时冠，以利形成牙间乳头
C. 内斜切口尽量保留龈缘组织尤其是根分叉处
D. 翻开全厚瓣，充分暴露分叉区，并刮除病变组织
E. 术前先进行根管治疗，髓室内用银汞合金充填

正确答案：B。伤口愈合期间最好不要制作暂时冠，以利形成牙间乳头

解析：分根术的手术方法：①术前先进行根管治疗，髓室内用银汞合金充填。②内斜切口尽量保留龈缘组织尤其是根分叉处，以利于形成术后两个“单根牙”间的龈乳头；可在近、远中做垂直切口。③翻开全厚瓣，充分暴露分叉区，并刮除病变组织。④使用金刚砂钻或涡轮裂钻，从正对根分叉部位沿患牙牙冠的颊舌向发育沟切开，分为近、远中两半，形成两个独立的单根牙，修整近、远中两半牙体的外形。⑤彻底清创，刮除深部的病变组织，冲洗、止血，龈瓣复位、缝合；放置牙周塞治剂。伤口愈合期间最好制作暂时冠，以利形成牙间乳头，待6～8周后进行牙冠修复。掌握“根分叉病变”知识点。